患者白某，男，33岁。饮食过度，积滞内停，症见脘腹胀满，大便秘结，舌苔黄腻，脉沉实治宜选用
A. 保和丸
B. 枳实消痞丸
C. 木香槟榔丸
D. 枳实导滞丸
E. 健脾丸

正确答案：C。木香槟榔丸

解析：患者积滞内停为基本病机，饮食积滞，气机壅遏，则见脘腹胀满；肠胃传化失常，则大便秘结，舌苔黄腻，脉沉实，为湿热积滞之象，治当行气导滞，攻积泄热，方选木香槟榔丸（C对）。方中用木香、槟榔行气导滞，调中止痛，消脘腹胀满，除里急后重，为君药。大黄、牵牛攻积导滞，泄热通便；青皮、香附疏肝理气，消积止痛，助木香、槟榔行气导滞，共为臣药。莪术祛瘀行气，散结止痛；陈皮理气和胃，健脾燥湿；黄连、黄柏清热燥湿而止痢，均为佐药。保和丸功用为消食化滞，理气和胃，主治食积证（A错）。枳实消痞丸功用为消痞除满，健脾和胃，主治脾虚气滞，寒热互结证（B错）。枳实导滞丸功用为消食导滞，清热祛湿，主治湿热食积证（D错）。健脾丸功用为健脾和胃，消食止泻，主治脾虚食积证（E错）。